与面神经管相通
A. 破裂孔
B. 内耳门
C. 圆孔
D. 颈静脉孔
E. 筛孔

正确答案：B。内耳门

解析：面神经连于脑桥延髓沟外侧部，经内耳门、内耳道达内耳道底，穿内耳道底入面神经管，最后从茎乳孔出颅，因此内耳门与面神经管相通（B对）。